氟骨症病人血钙降低是由于
A. 氟引起肾脏重吸收降低
B. 血中氟与钙结合沉积于骨组织
C. 氟促进血中钙形成盐类而排出体外
D. 氟干扰钙的吸收
E. 氟促进降钙素的分泌

正确答案：B。血中氟与钙结合沉积于骨组织

解析：本题考查氟骨症病人血钙降低的原因。氟骨症是一种由长期高氟暴露引起的疾病，它会导致血液中的钙结合到氟离子上，形成氟钙沉积物，沉积在骨组织中（B对ACDE错），从而导致血液中的钙含量降低。